在队列研究中，对研究对象的随访可能发生
A. 失访偏倚
B. 信息偏倚
C. 混杂偏倚
D. 时间领先偏倚
E. 时间效应偏倚

正确答案：A。失访偏倚